阴囊包块，透光试验阳性，平卧后消失，多见于
A. 睾丸鞘膜积液
B. 精索鞘膜积液
C. 交通性鞘膜积液
D. 腹股沟斜疝
E. 睾丸肿瘤

正确答案：C。交通性鞘膜积液

解析：阴囊包块，透光试验阳性，平卧后消失，多见于交通性鞘膜积液（C对）。交通性鞘膜积液由于鞘状突完全未闭合，鞘膜囊的积液可经一小管与腹腔相通，因此，阴囊肿块在站立位是增大，平卧位时可以消失。透光试验阳性。睾丸鞘膜积液（A错）由于鞘状突闭合正常，鞘膜囊的积液不与腹腔相通，因此包块局限于阴囊内，卧位时不会消失。精索鞘膜积液（B错）表现为腹股沟管内较小的包块，牵拉同侧睾丸可见肿块移动。腹股沟斜疝（D错）多表现为腹股沟区一梨形或椭圆形的肿块，透光试验阴性。睾丸肿瘤（P574）（E错）的典型表现为睾丸肿胀或变硬，透光试验阴性。